制备静脉注射乳时，加入的豆磷脂是作为
A. 防腐剂
B. 矫味剂
C. 乳化剂
D. 抗氧剂
E. 助悬剂

正确答案：C。乳化剂

解析：本题考查注射剂常用附加剂。静脉注射用脂肪乳处方分析：精制大豆油-油相；精制大豆磷脂-乳化剂（C对）；注射用甘油-等渗调节剂；注射用水-溶剂。此处方中无防腐剂（A错）、矫味剂（B错）、抗氧剂（D错）和助悬剂（E错）。